某县有20万人口，其中农村人口占60%，现欲对40岁以上农村居民糖尿病患病率进行调查。本调查研究的总体应为该县所有的
A. 居民
B. 农村居民
C. 城镇居民
D. 40岁以上居民
E. 40岁以上农村居民

正确答案：E。40岁以上农村居民